用力牵拉肌肉时，肌张力突然降低的原因是
A. 肌梭抑制
B. 拮抗肌抑制
C. 骨骼肌疲劳
D. 协同肌兴奋
E. 腱器官兴奋

正确答案：E。腱器官兴奋

解析：用力牵拉肌肉时，梭外肌受外力牵拉伸长，肌梭同时也被拉长，位于肌梭中间的感受装置发生形变，Ⅰₐ和Ⅱ传入纤维神经冲动增多，肌梭兴奋（A错），引起支配同一肌肉的ɑ运动神经元兴奋，梭外肌收缩，产生牵张反射。牵拉肌肉诱发牵张反射后，因梭外肌张力增加，腱器官兴奋（E对），经Ib类纤维兴奋抑制性中间神经元，转而抑制ɑ运动神经元活动，肌张力降低，牵张反射减弱和及时终止。骨骼肌疲劳是指骨骼肌在长期工作的情况下做功能力下降，一次快速牵拉肌肉并不会造成骨骼肌疲劳（C错）。用力牵拉肌肉时，并不涉及拮抗肌和协同肌，所以拮抗肌抑制（B错）和协同肌兴奋（D错）不是正确选项。